女38岁。患慢性肝炎7年，要求给予避孕指导。应选择的避孕措施是
A. 安全期避孕
B. 阴茎套避孕
C. 口服短效避孕药
D. 长效避孕针
E. 皮下埋植避孕

正确答案：B。阴茎套避孕

解析：患者为中青年女性，患慢性肝炎7年（急、慢性肝炎或肾炎为甾体激素避孕药的禁忌证），要求给予避孕指导，应选择的避孕措施是阴茎套避孕（B对）。因患者有肝炎病史，不宜采用口服短效避孕药（C错）、长效避孕针（D错）、皮下埋置避孕（E错）。安全期避孕法（A错）又称自然避孕法，并不十分可靠，不宜推广。